女，30岁。尿频、尿急、尿痛3天，无发热。查体：肾区无叩击痛，血WBC5.6×10⁹/L，N0.66。尿沉渣镜检：WBC25-30/HP。下一步应采取的最佳措施为
A. 多饮水，不用抗生素
B. 抗生素治疗2周
C. 抗生素治疗3天
D. 抗生素治疗4周
E. 单剂量维生素治疗

正确答案：C。抗生素治疗3天

解析：中年妇女，尿频、尿急、尿痛，无发热，尿沉渣镜检：WBC25-30/HP。最可能的诊断为急性膀胱炎。因细菌感染所致，致病菌多为大肠埃希菌，应选用抗生素治疗。该女性患者为无并发症的单纯性膀胱炎，最佳措施为抗生素治疗3天（C对）。